肝固有动脉
A. 发自腹腔干
B. 位于胆总管左侧
C. 肝的功能性血管
D. 发出胆囊动脉
E. 参与围成胆囊三角

正确答案：B。位于胆总管左侧

解析：肝固有动脉（A错）发自肝总动脉。肝固有动脉位于胆总管左侧（B对）。发出胆囊动脉（D错）为肝右动脉。